依据《食品生产许可管理办法》，食品生产许可实行的原则是
A. 多地一证
B. 一地一证
C. 多企一证
D. 一企多证
E. 一企一证

正确答案：E。一企一证

解析：本题考查依据《食品生产许可管理办法》，食品生产许可实行的原则。依据《食品生产许可管理办法》，食品生产许可实行的原则是一企一证原则（E对ABCD错），即同一个食品生产者从事食品生产活动，应当取得一个食品生产许可证。